可以实施药品委托销售的是
A. 药品上市许可持有人
B. 药品零售企业
C. 医疗机构
D. 药品批发企业

正确答案：A。药品上市许可持有人

解析：本题考查网络销售药品的条件。药品网络销售者应当是取得互联网药品信息服务资格证书的药品上市许可持有人（A对）、药品经营企业。其他企业、机构（C错）及个人不得从事药品网络销售，法律法规另有规定的除外。药品上市许可持有人、药品批发企业（D错）通过自建网站（含移动应用程序等，下同），通过网络采购药品或将药品销售给其他药品上市许可持有人、药品生产企业、药品经营企业和药品使用单位，以及药品零售企业（B错）、医疗机构通过网络向药品上市许可持有人、药品批发企业采购药品的网络药品交易服务模式。